患者，男，40岁，诊断为带状疱疹。宜选用的外用抗病毒药物是
A. 利多卡因
B. 伐昔洛韦
C. 甲钴胺
D. 加巴喷丁
E. 喷昔洛韦

正确答案：E。喷昔洛韦

解析：本题考查带状疱疹的药物治疗。带状疱疹局部治疗以干燥和消炎为主。庖疹未破可外用0.25%炉甘石洗剂或阿昔洛韦软膏或喷昔洛韦（E对）乳膏。庖疹破溃时，可酌情用3%硼酸溶液或1∶5000呋喃西林溶液湿敷，或外用0.5%新霉素软膏或2%莫匹罗星软膏等。